关于骨盆的描述，正确的是
A. 由两侧髂骨和骶骨连接而成
B. 由两侧髋骨和骶骨连结而成
C. 女性骨盆耻骨下角比男性的大
D. 男性骨盆较短宽
E. 两侧耻骨下支连成耻骨弓

正确答案：C。女性骨盆耻骨下角比男性的大

解析：骨盆由左、右髋骨和骶骨 、尾骨以及其间的骨连结构成（AB错）。两侧坐骨支与耻骨下支连成耻骨弓（E错）。女性骨盆耻骨下角比男性的大（C对）。女性骨盆外形短而宽（D错）。